地西泮与奥沙西泮的化学结构比较，奥沙西泮的极性明显大于地西泮的原因是
A. 奥沙西泮的分子中存在酰胺基团
B. 奥沙西泮的分子中存在烃基
C. 奥沙西泮的分子中存在氟原子
D. 奥沙西泮的分子中存在羟基
E. 奥沙西泮的分子中存在氨基

正确答案：D。奥沙西泮的分子中存在羟基

解析：本题考查奥沙西泮与地西泮的结构和特性。奥沙西泮的极性明显大于地西泮的原因是奥沙西泮的分子中存在羟基（D对）。地西泮与奥沙西泮的结构关系如下：地西泮1位N-去甲基得到去甲西泮，地西泮3位羟基化得到替马西泮，二者进一步代谢则得到奥沙西泮。奥沙西泮结构上的3位羟基让奥沙西泮的极性大于地西泮，且让其可与葡萄糖醛酸结合后从尿排出体外。酰胺基团（A错）、烃基（B错）、氟原子（C错）、氨基（E错）均不是奥沙西泮的极性明显大于地西泮的原因。